下列药物中，治疗急性心源性肺水肿的首选药物是
A. 呋塞米
B. 螺内酯
C. 氢氯噻嗪
D. 氨苯蝶啶
E. 乙酰唑胺

正确答案：A。呋塞米

解析：静脉注射呋塞米（A对）能迅速扩张容量血管，使回心血量减少，在利尿作用发生前即可缓解急性肺水肿，是急性肺水肿的迅速有效的治疗手段之一。螺内酯（B错）也是保钾利尿剂，其作用机制是拮抗醛固酮，主要用于治疗与醛固酮升高有关的顽固性水肿、充血性心力衰竭。氢氯噻嗪（C错）是中效利尿剂，可用于治疗各种原因引起的水肿，对轻中度心源性水肿疗效较好，是慢性心功能不全的主要治疗药物之一。氨苯蝶啶（D错）是保钾利尿剂，临床上常与排钾利尿剂合用治疗顽固性水肿。乙酰唑胺（E错）是碳酸酐酶抑制剂，主要治疗青光眼、急性高山病、碱化尿液。